男，40岁。间断发热、腹泻3个月。体温最高达38.8℃，腹泻4~6次/日，水样便，体重下降5kg，有静脉吸毒史。查体：T38.6℃，消瘦，肺部未间及干湿性啰音，腹软，无明显压痛及反跳痛，肝脾肋下未触及。对明确诊断最有价值的检查是
A. 血常规
B. 血清抗体
C. 粪培养
D. 胸部X线片
E. 粪常规

正确答案：B。血清抗体

解析：患者中年男性，有静脉吸毒史（艾滋病传染重要途径），近3月间断发热、腹泻、体重下降明显，无其余明显特征，结合患者病史，临床表现，考虑诊断为艾滋病；艾滋病期。HIV-l/HIV-2抗体检测对明确诊断最有价值。血常规（A错）可确诊HIV继发细菌感染。X线检查（A错）有助于了解肺并发肺袍子菌、真菌、结核核分枝杆菌感染及卡波西肉瘤等情况。粪常规可查见隐孢子虫。（P127）